某单室模型药物在体内的吸收和消除均符合一级动力学特征，其吸收速率常数为2，半衰期为
A. 2.0小时
B. 1.0小时
C. 1.4小时
D. 0.35小时
E. 0.7小时

正确答案：E。0.7小时

解析：本题考查药物半衰期。一室模型药物半衰期公式为t1/2=0.693/k，题目所求吸收半衰期，故代入吸收速率常数k=2，t1/2=0.692/2，约为0.35（D对）。